舌神经阻滞麻醉区域是
A. 同侧下颌舌侧牙龈、黏骨膜、口底黏膜及舌前2/3部分
B. 同侧下颌磨牙舌侧牙龈、黏骨膜、口底黏膜及舌后2/3部分
C. 同侧下颌前牙舌侧牙龈、黏骨膜、口底黏膜及舌前2/3部分
D. 同侧下颌前牙及前磨牙舌侧牙龈、黏骨膜、口底黏膜及舌前2/3部分
E. 同侧下颌舌侧牙龈、黏骨膜、口底黏膜及舌后2/3部分

正确答案：A。同侧下颌舌侧牙龈、黏骨膜、口底黏膜及舌前2/3部分

解析：舌神经阻滞麻醉区域：同侧下颌舌侧牙龈、黏骨膜、口底黏膜及舌前2/3部分。掌握“颌面部常用局麻法及牙拔除的麻醉选择”知识点。